既解毒消肿，又开窍辟秽的药是
A. 硼砂
B. 蟾酥
C. 白芷
D. 远志
E. 白僵蚕

正确答案：B。蟾酥

解析：本题考查的是蟾酥的性能特点。既解毒消肿，又开窍辟秽的药是蟾酥（B对）。蟾酥：【性能特点】本品辛散温通，香开辟秽，毒大力强，专入心经。外用解毒消肿、止痛；内服除止痛外，又辟秽开窍而醒神。硼砂（A错）：【性能特点】本品甘能解毒，咸能软坚，凉可清热，入肺、胃经。外用清热解毒、消肿防腐，治喉肿、口疮、目疾。内服清肺热、化稠痰，治肺热痰黄、咳吐不利。白芷（C错）：【性能特点】本品辛散温燥，芳香开窍，主入阳明（胃）经，兼入太阴（肺）经。既善散风寒、除湿邪、通鼻窍与关节之窍；又善止痛、发表、止带，还能消散肿块、促进脓汁的排出。药力较强，风寒、风寒夹湿、寒湿所致诸证皆宜，尤善治眉棱骨痛、阳明头痛、风寒鼻塞或鼻渊头痛。治疮肿，初期兼表，既活血消散疮肿，又解表；中期脓未成可消，脓成未溃可溃，已溃脓多促排；后期脓尽生肌，宜渐减去。远志（D错）：【性能特点】本品辛散苦泄温通，入心、肺、肾经。既助心阳、益心气，使肾气上交于心而安神益智，又祛痰而开窍，善治心神不安或痰阻心窍诸证。还祛痰止咳、消散痈肿，治痰多咳嗽及疮痈肿痛。白僵蚕（E错）即僵蚕。僵蚕：【性能特点】本品辛发散，咸软坚，平而偏凉，入肝、肺经。既善息风化痰止痉，治肝风或痰热之惊痫抽搐；又能祛风而止痛、止痒，治风热或肝热之头痛目赤、咽痛及风疹瘙痒；还能化痰散结消肿，治瘰疬痰核、痄腮。